哪种职业肿瘤是发现最早的
A. 肺癌
B. 皮肤癌
C. 膀胱癌
D. 骨癌
E. 白血病

正确答案：B。皮肤癌